男，38岁。因反复左侧头痛半年，加重伴呕吐3天于急诊留观。查体：浅昏迷，双侧瞳孔为左侧3mm，右侧2mm，对光反应迟钝。右侧肢体肌力4级，右侧Babinski征阳性。引起病人浅昏迷、瞳孔不等大及其他阳性体征的最可能原因是
A. 枕骨大孔疝
B. 小脑幕切迹疝
C. 左侧动眼神经麻痹
D. 左侧视神经损害
E. 脑干功能障碍

正确答案：B。小脑幕切迹疝

解析：患者初步诊断为颅脑肿瘤，引起病人浅昏迷瞳孔不等大及其他阳性体征的最可能原因是颅脑肿瘤引起的慢性颅内压增高导致小脑幕裂孔疝（B对）形成。枕骨大孔疝（A错）表现为枕、颈部疼痛，颈强直或强迫头位，意识障碍，伴有后组脑神经受累表现（P92）。左侧动眼神经麻痹（C错）、左侧视神经损害（D错）均无对侧锥体束受损表现。脑干功能障碍（E错）不是最根本的病因，而是由小脑幕裂孔疝引起，因此答小脑幕裂孔疝更准确。